慢性边缘性颌骨骨髓炎在已明确骨质破坏的部位和范围，一般在病程几周后可施行病灶清除术
A. 2～4周
B. 4～6周
C. 6～8周
D. 2个月以上
E. 半年以上

正确答案：A。2～4周

解析：本题考查颌骨骨髓炎。慢性边缘性颌骨骨髓炎在已明确骨质破坏的部位和范围，一般在病程2～4周（A对）后，即可施行病灶清除术。